某医师治疗咳喘时常用冬病夏治敷贴膏，此膏中所含芥子的功效是
A. 燥湿化痰，祛风止痉
B. 消痰散结，降气止呕
C. 温肺祛痰，利气散结
D. 清热化痰，润肺止咳
E. 清宜肺气，消痰软坚

正确答案：C。温肺祛痰，利气散结

解析：本题考查的是芥子的功效。芥子的功效是温肺祛痰，利气散结（C对）。芥子：【功效】温肺祛痰，利气散结，通络止痛。天南星：【功效】燥湿化痰，祛风止痉（A错），散结消肿。川贝母：【功效】清热化痰，润肺止咳（D错），散结消痈。功效为消痰散结，降气止呕（B错）或清宜肺气，消痰软坚（E错）的中药，2022年考试指南未明确说明。